胃排空速率加快时，药效减弱的药物是
A. 阿司匹林肠溶片
B. 地西泮片
C. 硫糖铝胶囊
D. 红霉素肠溶胶囊
E. 左旋多巴片

正确答案：C。硫糖铝胶囊

解析：本题考查胃排空速率快对药物吸收产生的影响。胃排空速率加快时，药效减弱的药物是硫糖铝胶囊（C对）；阿司匹林（A错）、地西泮（B错）主要在肠道吸收；红霉素（D错）、左旋多巴（E错）在胃内易破坏，胃排空加快药效增强。